植物油中加入三乙醇胺，强力搅拌制备乳膏剂的方法属于
A. 干胶法
B. 湿胶法
C. 两相交替加入法
D. 新生皂法
E. 机械法

正确答案：D。新生皂法